确诊伤寒最常用的检测方法是
A. 粪便培养
B. 血培养
C. 尿培养
D. 骨髓培养
E. 胆汁培养

正确答案：B。血培养

解析：确诊伤寒最常用的检查方法是血培养（B对）；骨髓培养（D错）更适用于已用抗菌药物、血培养阴性者；粪便培养（A错）、尿培养（C错）阳性率均低于前两者，分别为75%、25%左右，不作首选；胆汁培养（E错）因操作不便，一般很少使用。